在注射剂、滴眼剂的生产中使用的溶剂是
A. 饮用水
B. 注射用水
C. 去离子水
D. 纯化水
E. 灭菌注射水

正确答案：B。注射用水

解析：本题考查液体制剂常用溶剂。注射用水（B对） 为纯化水经蒸馏所得的水，可作为注射剂、滴眼剂生产时所用溶剂。